女，25岁。低热，腹痛1个月，尿少，腹围增加1周。查体腹部弥漫压痛（+），呈揉面感，移动性浊音阳性。患者诊断最有意义的检查是
A. 血常规及血沉
B. 肾功能
C. 腹腔穿刺
D. 尿常规
E. 妇科盆腔检查

正确答案：C。腹腔穿刺

解析：青年女性患者，低热（结核毒血症状）、腹痛1个月。查体：腹壁柔韧感（结核性腹膜炎的典型体征），有弥漫压痛，移动性浊音阳性（腹水阳性）。综合患者病史与体检，考虑诊断为结核性腹膜炎。腹腔穿刺（C对）可检查腹水性质、测定ADA（腺苷脱氨酶），是对该患者诊断最有意义的检查。血沉增高可见于多种疾病，如急性炎症、白血病、结缔组织病及结核病的活动期，不具有特异性；血常规可用于鉴别患者的发热原因。故血常规及血沉（A错）对结核性腹膜炎的诊断价值不大。肾功能（B错）与尿常规（D错）可用于诊断泌尿系统疾病。妇科盆腔检查（E错）主要用来诊断妇科疾病。